在X线片上，髓室及根管影像完全消失，不能分辨出髓腔界线，表示有
A. 牙髓充血
B. 牙髓炎
C. 弥散性牙髓钙化
D. 牙髓坏死
E. 牙内吸收

正确答案：C。弥散性牙髓钙化

解析：本题考查弥散性牙髓钙化的X线表现。牙髓钙化是当牙髓的血液循环发生障碍时，导致牙髓组织营养不良，出现细胞变性，钙盐沉积，形成微小或大块的钙化物质。X线可作为其重要的诊断依据。在X线片上，弥散性牙髓钙化（C对）显示出髓室及根管影像完全消失，不能分辨出髓腔界线。牙髓充血（A错）、牙髓炎（B错）及牙髓坏死（D错）X线片显示患牙髓室及根管影像形态正常，髓腔界限明显。牙内吸收（E错）X线片显示髓腔内有局限性不规则的膨大透射区，严重者可见内吸收处的髓腔壁被穿通，甚至出现牙根折断线。